子宫内膜癌的首选治疗方法是
A. 手术治疗
B. 手术、放射联合治疗
C. 放射治疗
D. 激素治疗
E. 化学治疗

正确答案：A。手术治疗

解析：子宫内膜癌的首选治疗方法是手术治疗（A对）。放射治疗（C错）适用于有手术禁忌症或无法手术切除的晚期患者。化疗（E错）为晚期或复发子宫内膜癌综合治疗措施之一。手术放射联合治疗（B错）是Ⅰ期高危和Ⅱ期内膜癌最主要的术后辅助治疗。孕激素治疗（D错）主要用于晚期或复发癌。